某女，56岁，小便点滴而下，量极少而短赤灼热，小腹胀满，口苦口黏，渴不欲饮，大便不畅。舌质红，苔黄腻，脉滑数。治疗宜选用的方剂是
A. 八正散
B. 代抵当丸
C. 济生肾气丸
D. 参苓白术散
E. 逍遥散

正确答案：A。八正散

解析：本题考查的是癃闭的辨证论治。小便点滴而下，量极少而短赤灼热，小腹胀满，口苦口黏，渴不欲饮，大便不畅。舌质红，苔黄腻，脉滑数。治疗宜选用的方剂是八正散（A对）。癃闭是以小便量少，排尿困难，甚则小便闭塞不通为主症的疾病。西医学中各种原因引起的尿潴留及无尿症，如神经性尿闭、膀胱括约肌痉挛、尿道结石、尿路肿瘤、尿道损伤、尿道狭窄、前列腺增生症、脊髓炎等病所出现的尿潴留以及肾功能不全引起的少尿、无尿症，可参考此内容辨证论治，但同时还应注意结合辨病求因治疗。（一）膀胱湿热证：【症状】小便点滴不通，或量极少而短赤灼热，小腹胀满，口苦口黏，或口渴不欲饮，或大便不畅。舌质红，苔黄腻，脉数。【方剂应用】基础方剂为八正散（车前子、瞿麦、萹蓄、滑石、山栀子仁、甘草、木通、大黄、灯心草）加减。（二）湿热瘀阻证：【症状】小便点滴而下，或尿如细线，甚则阻塞不通，烦躁口苦。舌质紫暗或有瘀点。舌苔黄腻，脉涩。【方剂应用】基础方剂为代抵当汤（B错）（大黄、当归尾、生地黄、穿山甲、芒硝、桃仁、肉桂、降香）加减。（三）肾阳衰惫证：【症状】小便不通或点滴不爽，排出无力，面色㿠白，神气怯弱，畏寒肢冷，腰膝冷而酸软无力。舌淡胖，苔薄白，脉沉细或弱。【方剂应用】基础方剂为济生肾气丸（C错）（熟地黄、山茱萸、山药、茯苓、泽泻、牡丹皮、肉桂、附子、车前子、牛膝）加减。参苓白术散（D错）为消渴脾胃气虚证的方剂应用。消渴脾胃气虚证：【症状】口渴引饮，能食与便溏并见，或饮食减少，精神不振，四肢乏力。舌淡，苔薄白而干，脉细弱无力。【方剂应用】基础方剂为参苓白术散（莲子肉、薏苡仁、砂仁、桔梗、白扁豆、白茯苓、人参、甘草、白术、山药）加减。逍遥散（E错）为经前后诸证肝郁肾虚证的方剂应用。经前后诸证肝郁肾虚证：【症状】经断前后，阵发性烘热汗出，腰膝酸软，烦躁易怒，情绪异常，头晕耳鸣，乳房胀痛，月经紊乱，或胸闷善太息。舌淡红或偏暗，苔薄白，脉弦细。【方剂应用】基础方剂为一贯煎（北沙参、麦冬、当归、生地黄、枸杞子、川楝子）合逍遥散（柴胡、当归、白芍、白术、茯苓、甘草、薄荷、煨姜）加减。